下列井穴中，具有催乳作用的穴位是
A. 少商
B. 关冲
C. 中冲
D. 少泽
E. 隐白

正确答案：D。少泽

解析：少泽（D对）主治乳痈、乳少等乳疾、昏迷、热病、头面五官病证等。少商（A错）主治肺系实热证、癫狂等。关冲（B错）主治头面五官病证及热病、中暑。中冲（C错）主治中风昏迷、中暑等急症；心与神志疾患；口疮、口臭；鹅掌风。隐白（E错）主治月经过多、崩漏等妇科病；便血、尿血等慢性出血；癫狂、多梦；惊风；腹满、暴泻。